属于凝血因子Xa直接抑制剂的抗凝药是
A. 依诺肝素
B. 肝素
C. 华法林
D. 利伐沙班
E. 达比加群酯

正确答案：D。利伐沙班

解析：本题考查凝血因子Xa直接抑制剂。利伐沙班（D对）属于凝血因子Xa直接抑制剂的抗凝药。依诺肝素（A错）、肝素（B错）抑制凝血酶原转变为凝血酶，可防止急性血栓形成。华法林（C错）为维生素K拮抗剂类抗凝血药。达比加群酯（E错）属于直接凝血酶抑制剂类抗凝血药。